某男，45岁。平素喜饮浓茶，嗜好烟酒，经常熬夜。现入睡困难，且多梦易醒心悸健忘，虚烦不安，时有盗汗，舌淡，苔薄，脉细。医师诊断为不寐。宜采用的治法是
A. 交通心肾
B. 滋阴养血
C. 清心泻火
D. 疏肝解郁
E. 健脾养心

正确答案：A。交通心肾

解析：本题考查的是不寐的辨证论治。平素喜饮浓茶，嗜好烟酒，经常熬夜。现入睡困难，且多梦易醒心悸健忘，虚烦不安，时有盗汗，舌淡，苔薄，脉细。医师诊断为不寐。宜采用的治法是交通心肾（A对）。不寐是以经常不能获得正常睡眠为特征的疾病，主要表现为睡眠时间、深度的不足，轻者入睡困难，或寐而不酣，时寐时醒，或早醒，或醒后不能再寐，重则彻夜不寐。西医学中神经症，以及多种心脑血管疾病、贫血、肝病等疾病以失眠为主要表现者，可参考此内容辨证论治。（一）肝火扰心证：【症状】不寐多梦，甚则彻夜不眠，急躁易怒，伴头晕头胀，目赤耳鸣，口干而苦，不思饮食，便秘溲赤。舌红苔黄，脉弦而数。【治法】疏肝泻火，镇心安神。（二）痰热扰心证：【症状】心烦不寐，胸闷脘痞，泛恶嗳气，伴口苦，头重，目眩。舌质偏红，苔黄腻，脉滑数。【治法】清化热痰，和中安神。（三）心脾两虚证：【症状】不易入睡，多梦易醒，心悸健忘，神疲食少，伴头晕目眩，四肢倦怠，腹胀便溏，面色少华。舌淡苔薄，脉细无力。【治法】补益心脾，养血安神。（四）心肾不交证：【症状】心烦不寐，入睡困难，心悸多梦，伴头晕耳鸣，腰膝酸软，潮热盗汗，五心烦热，咽干少津，男子遗精，女子月经不调。舌红少苔，脉细数。【治法】滋阴降火，交通心肾。（五）心胆气虚证：【症状】虚烦不眠，触事易惊，终日惕惕，胆怯心悸，伴气短自汗，倦怠乏力。舌淡，脉弦细。【治法】益气镇惊，安神定志。滋阴养血（B错）为血虚头痛的治法。血虚头痛：【症状】头痛隐隐，时时昏晕，心悸失眠，面色少华，神疲乏力，遇劳加重。舌质淡，苔薄白，脉细弱。【治法】养血滋阴，和络止痛。疏肝解郁（D错）为郁证肝气郁结证的治法。郁证肝气郁结证：【症状】精神抑郁，情绪不宁，胸部满闷，胁肋胀痛，痛无定处，胸闷嗳气，喜太息，不思饮食，大便不调，或秘或溏泄。舌苔薄或腻，脉弦。【治法】疏肝解郁，理气畅中。健脾养心（E错）为郁证心脾两虚证的治法。郁证心脾两虚证：【症状】情绪不宁，多思善疑，头晕神疲，心悸胆怯，失眠健忘，食少纳呆，面色不华。舌质淡，苔薄白，脉细。【治法】健脾养心，补益气血。治法为清心泻火（C错）的病证，2022年考试指南未明确说明。